疾病后期遗留某些后遗症的主要病机是
A. 正胜邪退
B. 邪去正虚
C. 邪胜正衰
D. 邪正相持
E. 正虚邪恋

正确答案：E。正虚邪恋

解析：该题考查邪正盛衰与疾病转归。正虚邪恋，多见于疾病后期，且是多种疾病由急性转为慢性，或慢性疾病久治不愈，或遗留某些后遗症的主要原因之一（E对）。正胜邪退，疾病趋向于好转和痊愈（A错）。邪去正虚，多见于重病的恢复期（B错）。邪胜正衰，疾病趋向恶化，甚则导致死亡（C错）。邪正相持，疾病趋向于迁延或慢性化（D错）。